炎症性发热
A. 调节性体温升高
B. 被动性体温升高
C. 两者均可
D. 两者均无
E. 无

正确答案：A。调节性体温升高

解析：炎症性发热是由于炎症引起的发热，而引起机体出现炎症的致炎因子可以作为致热原使体温调定点上移而引起调节性体温升高（A对）。